主产地为贵州，属于“贵药”的道地药材是
A. 地黄
B. 龙胆
C. 天麻
D. 白术
E. 巴戟天

正确答案：C。天麻

解析：本题考查常用的道地药材。主产地为贵州，属于“贵药”的道地药材是天麻（C对）。贵药：主产地贵州。如天冬、天麻、黄精、杜仲、吴茱萸、五倍子、朱砂等。怀药：主产地河南。如著名的“四大怀药”—地黄（A错）、牛膝、山药、菊花；以及天花粉、瓜蒌、白芷、辛夷、红花、金银花、山茱萸等。关药：主产地山海关以北、东北三省及内蒙古东部。如人参、鹿茸、细辛、辽五味子、防风、关黄柏、龙胆（B错）、平贝母、刺五加、升麻、桔梗、哈蟆油、甘草、麻黄、黄芪、赤芍、苍术等。浙药：主产地浙江。如传统的“浙八味”—浙贝母、白术（D错）、延胡索、温郁金、玄参、杭白芍、杭菊花、杭麦冬，以及山茱萸、莪术、杭白芷、栀子、乌梅、乌梢蛇等。广药：又称“南药”，主产地广东、广西、海南及台湾。如阳春砂、广藿香、广金钱草、益智仁、广陈皮、广豆根、蛤蚧、肉桂、桂莪术、苏木、巴戟天（E错）、高良姜、八角茴香、化橘红、樟脑、桂枝、槟榔等。